出脚间窝的脑神经是
A. 面神经
B. 动眼神经
C. 展神经
D. 滑车神经
E. 三叉神经

正确答案：B。动眼神经

解析：动眼神经（B对）由中脑脚间窝出脑；面神经（A错）经内耳门、内耳道达内耳道底，穿内耳道底入面神经管，最后从茎乳孔出颅；展神经（C错）自脑桥延髓沟中线两侧出脑；滑车神经（D错）自中脑下丘下方出脑；三叉神经（E错）自脑桥基底部与小脑中脚交界处出脑。